通过产生一氧化氮（NO）松驰血管平滑肌的药物是
A. 双嘧达莫
B. 硝苯地平
C. 硝酸甘油
D. 普萘洛尔
E. 曲美他嗪

正确答案：C。硝酸甘油

解析：本题考查硝酸甘油。硝酸甘油（C对）进入平滑肌细胞可分解为NO，增加cGMP的生成，使钙离子从细胞释放而松弛平滑肌。双嘧达莫（A错）抑制血小板聚集，具有抗血栓形成作用和血管有扩张作用。硝苯地平（B错）钙离子通道阻滞剂。普萘洛尔（D错）β受体阻断剂。曲美他嗪（E错）通过抑制游离脂肪酸代谢发挥作用。